治疗脾胃虚寒，脘腹冷痛，兼寒饮伏肺，咳嗽气喘痰多清稀者，应首选
A. 附子
B. 肉桂
C. 干姜
D. 细辛
E. 高良姜

正确答案：C。干姜

解析：脾胃虚寒，脘腹冷痛，治当温中散寒，寒引伏肺，咳嗽气喘治当温肺化饮，所以首选具有温中散寒，温肺化饮的功效的药物。附子具有回阳救逆，补火助阳，散寒止痛的功效，无温肺化饮之功（A错）。肉桂具有补火助阳，散寒止痛，温经通脉，引火归原的功效，无温肺化饮之功（B错）。干姜具有温中散寒，回阳通脉，温肺化饮的功效（C对）。细辛具有解表散寒，祛风止痛，通窍，温肺化饮的功效，无温中之功（D错）。高良姜具有散寒止痛，温中止呕的功效，无温肺化饮之功（E错）。